超高频辐射脉冲波每日8小时接触容许限值是
A. 0.025μW/cm²
B. 0.05μW/cm²
C. 0.025mW/cm²
D. 50μW/cm²
E. 0.05mW/cm²

正确答案：C。0.025mW/cm²